某男，40岁。3年前头部曾受外伤经住院治疗症状改善。近6个月反复头痛，部位固定在左颞部，痛如锥刺，舌紫暗，苔薄白，脉涩。宜选用的方剂是
A. 羚角钩藤汤加减
B. 川芎茶调散加减
C. 补阳还五汤加减
D. 通窍活血汤加减
E. 桃仁承气汤加减

正确答案：D。通窍活血汤加减

解析：本题考查的是头痛的辨证论治。3年前头部曾受外伤经住院治疗症状改善。近6个月反复头痛，部位固定在左颞部，痛如锥刺，舌紫暗，苔薄白，脉涩。宜选用的方剂是通窍活血汤加减（D对）。瘀血头痛：【症状】头痛经久不愈，痛处固定不移，痛如锥刺，或有头部外伤史。舌紫暗，或有瘀斑，瘀点，苔薄白，脉细或细涩。【方剂应用】基础方剂为通窍活血汤（赤芍、川芎、桃仁、红花、麝香、老葱、鲜姜、枣、酒）加减。川芎茶调散加减（B错）为风寒头痛的方剂应用。风寒头痛：【症状】头痛时作，痛连项背，常有拘急收紧感，伴恶风畏寒，受风尤剧，口不渴。舌苔薄白，脉浮紧。【方剂应用】基础方剂为川芎茶调散（川芎、荆芥、薄荷、羌活、细辛、白芷、甘草、防风）加减。补阳还五汤加减（C错）为胸痹气虚血瘀证的方剂应用。胸痹气虚血瘀证：【症状】胸痛隐隐，遇劳则发，神疲乏力，气短懒言，心悸自汗。舌胖有齿痕，色淡暗，苔薄白，脉弱而涩，或结、代。【方剂应用】基础方剂为补阳还五汤（当归、川芎、黄芪、桃仁、红花、地龙、赤芍）加减。方剂应用为羚角钩藤汤加减（A错）或桃仁承气汤加减（E错）的病证，2022年考试指南未明确说明。